患者，男，70岁。有多年排尿困难，呈淋漓状，近2年来双侧腹股沟区出现半圆形肿块，站立时明显，平卧后消失，体检时压迫内环肿块仍出现，诊断为
A. 腹股沟斜疝
B. 腹股沟直疝
C. 股疝
D. 切口疝
E. 巨大疝

正确答案：B。腹股沟直疝

解析：老年（腹股沟直疝的好发人群）男性患者，多年排尿困难史（可引起腹内压增高），近2年来双侧腹股沟区出现半球形肿块，站立时明显，平卧后消失，压迫内环肿块仍出现（腹股沟直疝的典型临床表现），结合患者病史和临床表现，应诊断为腹股沟直疝（B对）。腹股沟斜疝（A错）多见于儿童及青壮年，疝块呈椭圆或梨形，回纳后压住内环肿块不再突出。股疝（C错）多见于40岁以上妇女，疝块位于腹股沟韧带下方，平卧后疝块不能完全消失。切口疝（P316）（D错）指发生于腹壁手术切口处的疝，占腹外疝的第三位，最常发生于经腹直肌切口。巨大疝（E错）平卧后疝块不会自行回纳，且易发生崁顿。